我国的法定传染病监测属于
A. 主动监测
B. 被动监测
C. 哨点监测
D. 以实验室为基础的监测
E. 以医院为基础的监测

正确答案：B。被动监测

解析：本题考查被动监测。被动监测是指下级单位常规地向上级机构报告监测资料，而上级单位被动地接受。被动监测主要是依据相关的法律法规要求而进行，我国的法定传染病报告信息系统、突发公共卫生事件报告系统、药品不良反应（ADR）监测自发报告系统等多属于被动监测（B对ACDE错）范畴。